男性，40岁，渔民。因发热1周伴腹痛、腹胀、腹泻，大便每日3~4次，稀便有黏冻，村卫生室给服氯霉素5天，患者热退，症状好转，继续工作，2周后再次发热，体温39℃，抽血培养有伤寒杆菌生长。患者经有效治疗后痊愈，患者病后可获得
A. 暂时免疫
B. 对伤寒有持久性免疫
C. 有一定免疫力
D. 无免疫力，可再次患伤寒
E. 对伤寒与副伤寒均有免疫力

正确答案：B。对伤寒有持久性免疫